称为“水谷气血之海”的是
A. 脾
B. 大肠
C. 小肠
D. 胃
E. 三焦

正确答案：D。胃

解析：由于机体精气血津液的化生，都依赖于饮食水谷，故胃有“水谷气血之海”之称。（D对）。脾（A错）为“气血生化之源”。大肠（B错）之气的运动，将粪便向下传送，并经肛门排出体外，故称为“传导之官”。小肠（C错）为“受盛之官”。“三焦（E错）者，决渎之官，水道出焉”。